患者女性，28岁。停经30天后，腹痛伴阴道出血10天，量少今起腹痛加重而就诊β-hCG（+）。妇检：宫颈举痛（+），少许血染，子宫正常大小，附件区触及边界不清之块物，压痛（+）。考虑最可能是下列何种疾病
A. 附件炎
B. 流产继发感染
C. 卵巢囊肿继发感染
D. 难免流产
E. 输卵管妊娠

正确答案：E。输卵管妊娠

解析：输卵管妊娠表现：停经史，β-hCG（+），腹痛，阴道流血，腹部包块（附件区触及边界不清之块物）。查体有宫颈举痛（输卵管妊娠的主要体征之一），触及附件区胀大的肿物。掌握“异位妊娠”知识点。